具有性激素样作用的补虚药是
A. 麦冬
B. 白术
C. 鹿茸
D. 龟甲
E. 北沙参

正确答案：C。鹿茸

解析：本题考查中药功能作用。具有性激素样作用的补虚药是鹿茸（C对）。补虚方药具有改善内分泌功能的作用。少数补虚方药中所含成分本身具有性激素样作用，如鹿茸中含有雌二醇。麦冬（A错）的药理作用：麦冬提取物具有抗心肌缺血的作用，并呈现出一定的量效关系，大剂量组能明显改善心肌缺血引起的细胞超微结构的改变。白术（B错）味甘、苦，性温。归脾、胃经。具有健脾益气，燥湿利水，止汗，安胎的功能。白术以健脾燥湿、利水消肿为主，生品与炒品相比祛湿力强，用于脾虚食少，腹胀泄泻，痰饮眩悸，水肿，自汗，胎动不安。龟甲（D错）滋阴潜阳，益肾强骨，养血补心，固经止崩。用于阴虚潮热，骨蒸盗汗，头晕目眩，虚风内动，筋骨痿软，心虚健忘，崩漏经多。北沙参（E错）味甘、苦、淡，性凉，入肺、脾经，具有养阴清肺，祛痰止咳的功效，主治肺热燥咳，虚痨久咳，阴伤咽干、口渴。